实验流行病学的随访观察内容不包括的选项是
A. 干预措施的执行状况
B. 研究对象的人口学资料
C. 有关的影响因素（预后影响因素）
D. 次要结局
E. 主要结局

正确答案：B。研究对象的人口学资料

解析：本题考查实验流行病学的随访观察内容。实验流行病学的随访观察内容包括：①干预措施的执行状况（A对）；②有关影响因素（预后影响因素）的信息（C对）；③结局变量（DE对）。研究对象的人口学资料（B错，为本题正确答案）不在随访观察内容的范畴之中。